制何首乌应选用的辅料是
A. 米醋
B. 蜂蜜
C. 盐水
D. 甘草水
E. 黑豆汁

正确答案：E。黑豆汁

解析：本题考查何首乌的炮制方法。制何首乌应选用的辅料是黑豆汁（E对）。何首乌【炮制方法】处方用名有何首乌、首乌、生首乌、制首乌。①何首乌：取原药材，除去杂质，洗净，稍浸，闷润，润透，切厚片或块，干燥。②制何首乌：取何首乌片或块，用黑豆汗拌匀，润透，置非铁质蒸制容器内，密闭，炖至汁液吸尽，药物呈棕褐色，或用清蒸法，或黑豆汁拌匀后，蒸至药物内外均成棕褐色，取出，干燥，或晒至半干，切片，干燥。每100kg何首乌片（块），用黑豆10kg。醋及其作用：醋古称酢、醯、苦酒，习称米醋（A错）。醋多用作炙、蒸、煮等辅料，常用醋制的药物有延胡索、甘遂、商陆、大戟、芫花、三棱、莪术、香附、柴胡、郁金等。蜂蜜（B错）及其作用：蜂蜜为蜜蜂科中华蜜蜂等采集花粉酿制而成，品种比较复杂，以枣花蜜、山白蜜、荔枝蜜等质量为佳，荞麦蜜色深有异臭，质差。常用蜂蜜炮制的药物有甘草、麻黄、紫菀、百部、马兜铃、白前、枇杷叶、款冬花、百合、桂枝等。盐水（C错）及其作用：炮制所用盐水为食盐水。常以盐水炮制的药物有知母、黄柏、杜仲、巴载天、小茴香、橘核、车前子、砂仁、菟丝子、补骨脂、益智仁、泽泻、沙苑子等。中药炮制中还有用到其他液体辅料的，主要有吴茱萸汁、白萝卜汁、羊脂油、鳖血、山羊血、石灰水、甘草汁（D错）、黑豆汁及其他药汁等。可根据中医临床的用药要求而选用。